中枢性尿崩症患者控制多尿最适宜的药物是
A. 垂体后叶素水剂
B. 油剂鞣酸加压素（长效尿崩停）
C. 去氨加压素（弥凝）
D. 双氢克尿塞
E. 氯磺丙脲

正确答案：C。去氨加压素（弥凝）

解析：中枢性尿崩症患者，抗利尿激素（AVP，精氨酸加压素）的合成、转运、储存及释放受到影响，导致其血中AVP浓度下降。由于其尿量增多的原因为精氨酸加压素缺乏，因此为控制多尿应补充精氨酸加压素或其类似物。去氨加压素（C对）为人工合成的加压素类似物，抗利尿作用强，且不良反应较少，是治疗尿崩症的首选药物。垂体后叶素水剂（P675）（A错）为激素替代治疗药物，需注射治疗，口服无效，且每次注射维持作用时间较短，每日需多次注射，不便长期应用，主要用于颅脑外伤或术后神志不清的尿崩症患者。油剂鞣酸加压素注射液（P675）（B错）注射后维持时间较长，可减少频繁注射的麻烦，但是长期应用两年左右会因产生抗体而减效，注射过量会引起水中毒。双氢克尿噻（D错）即氢氯噻嗪为肾性尿崩症的主要治疗药物，也用于中枢性尿崩症，但效果不如去氨加压素好。非激素类抗利尿药物如氯磺丙脲（E错）（P675）、卡马西平等，可刺激AVP释放并增强AVP对肾小管的作用，但抗利尿作用不及去氨加压素，临床上不作为首选治疗。